腹部平片不显影的结石是
A. 草酸盐结石
B. 尿酸结石
C. 混合型结石
D. 碳酸盐结石
E. 磷酸盐结石

正确答案：B。尿酸结石

解析：尿结石主要由尿中难溶的无机盐、有机盐和酸的晶体所组成，临床上常以晶体成分命名结石。尿结石中，以含钙结石最常见，在X线平片上能显影，称为阳性结石，如草酸钙结石（A错）、磷酸钙结石（E错）、碳酸钙结石（D错）、混合性结石（C错）等。阴性结石不含钙盐，可透过X线，在X线平片上不显影，如纯尿酸结石（B对）、胱氨酸结石等。